在传染过程中隐性感染者增加时，其流行病学的重要意义在于
A. 轻型病人增加
B. 带菌者增加
C. 发病率升高
D. 免疫人群扩大
E. 潜在性感染增加

正确答案：D。免疫人群扩大

解析：本题考查隐性感染者增加的流行病学意义。在传染过程中隐性感染者增加时，其获得了特异性免疫力，流行病学的重要意义在于免疫人群扩大（D对ABCE错）。